血瘀所致儿枕痛的腹痛特点是
A. 小腹疼痛拒按，得热痛减
B. 小腹疼痛拒按，得热痛剧
C. 小腹灼热疼痛，拒按
D. 小腹疼痛，喜按
E. 小腹疼痛，拒按

正确答案：E。小腹疼痛，拒按

解析：产后腹痛因瘀血所致者又称“儿枕痛”。血瘀者，小腹疼痛拒按，恶露色暗有块，是由于产后血室正开，起居不慎，寒邪乘虚而入，血为寒凝；或因情志不畅，肝郁气结，血随气结而成瘀，或恶露当下不下，瘀阻冲任，胞脉失畅，“不通则痛”（E对）。